《素问•调经论》说：“血不足”，则
A. 怒
B. 喜
C. 思
D. 悲
E. 恐

正确答案：E。恐

解析：本题是对原文的考查，需对原文有所了解。《素问·调经论》说：“血有余则怒，不足则恐（E对）。”